乳酸供能的特点不包括
A. 一般出现在大体力劳动中
B. 不能持久
C. 易疲劳
D. 消耗脂肪供能较多
E. 速度较快

正确答案：D。消耗脂肪供能较多